表现为牙龈肿大的龈病损时应做的鉴别诊断除外的是
A. 炎症性增生
B. 药物性增生
C. 龈纤维瘤病
D. 坏死性溃疡性龈炎
E. 慢性牙髓炎

正确答案：E。慢性牙髓炎

解析：本题考查牙龈肿大疾病的鉴别。表现为牙龈肿大的龈病损时应做的鉴别诊断除外的是慢性牙髓炎（E错，为本题正确答案）。以牙龈增生为主要表现的疾病主要有：（1）药物性牙龈肥大（B对）；（2）牙龈纤维瘤病（C对）；（3）白血病引起的牙龈肥大；（4）浆细胞性龈炎；（5）炎症性牙龈增生（A对）；（6）坏死性溃疡性龈炎（D对）。